混杂因子是指
A. 与研究的疾病有联系的因子
B. 与研究的暴露没有关系的因子
C. 与研究的疾病和暴露都有联系的因子
D. 与研究的疾病和暴露都没有联系的因子
E. 上述都不是

正确答案：C。与研究的疾病和暴露都有联系的因子

解析：本题考查混杂因子的概念。混杂因子与研究的因素和研究的疾病均有关（C对ABDE错），且不是因果的中间变量，若在比较的人群组中分布不匀，可以歪曲（掩盖或夸大）因素与疾病之间真正联系的因素。